标定高氯酸滴定液（0.1mol/1）的基准物是
A. 硫酸
B. 氯化钠
C. 邻苯二甲酸氢钾
D. 重铬酸钾
E. 无水碳酸钠

正确答案：C。邻苯二甲酸氢钾

解析：本题考查基准物的选择。《中国药典》使用基准邻苯二甲酸氢钾（C对）标定高氯酸滴定液，结晶紫为指示剂。